治疗脏躁，应选用的的代表方剂是
A. 血府逐瘀汤
B. 生脉散
C. 甘麦大枣汤
D. 逍遥散
E. 安神补心丸

正确答案：C。甘麦大枣汤

解析：甘麦大枣汤主治心阴不足，肝气失和之脏躁，精神恍惚、喜悲伤欲哭等。由因思虑过度，心阴受损，肝气失和所致，用以养心安神，和中缓急，为治疗脏燥的常用方（C对）。血府逐瘀汤治疗胸中血瘀证（A错）。生脉散治疗温热、暑热，耗气伤阴证，久咳伤肺，气阴两虚证（B错）。逍遥散治疗肝郁血虚脾弱证（D错）。安神补心丸治疗心悸失眠、头晕耳鸣（E错）。